肺结核早期诊断最主要的方法是
A. 痰结核菌检查
B. X线检查
C. 结核菌素试验
D. 血沉
E. 白细胞计数和分类

正确答案：B。X线检查

解析：肺结核是由结核杆菌感染引起的肺部疾患，因常规X线胸片可以解决肺结核的大部分诊断，故肺结核早期诊断最主要的方法是X线检查（B对）。痰结核菌检查（A错）常用于肺结核的确诊以及判断肺结核有无传染性。结核菌素试验（C错）对儿童、少年和青年的结核病诊断有一定的参考意义。血沉（D错）、白细胞计数和分类（E错）对肺结核的进展和预后有一定的意义。